引起继发性再生障碍性贫血最常见的病因是
A. 药物及化学物质
B. 物理因素
C. 病毒感染
D. 细菌感染
E. 营养因素

正确答案：A。药物及化学物质

解析：引起继发性再生障碍性贫血的病因有①药物及化学物质（A对）：最常见，特别是氯霉素类抗生素、磺胺类药物、抗肿瘤化疗药物以及苯等；②物理因素（B错）：X线、镭及放射性核素等；③病毒感染（C错）：肝炎病毒、微小病毒B19等。细菌感染（D错）常引起慢性病性贫血；营养因素（E错）可引起缺铁性贫血、巨幼细胞性贫血等。